进行暴发调查时的首要工作是
A. 确定可能的传播方式
B. 形成假设并检验假设
C. 确定问题，核实诊断
D. 采取预防措施
E. 扑灭疫情

正确答案：C。确定问题，核实诊断